伤寒患者，症状轻，可照常工作，因肠穿孔就医而被发现，其临床分型是
A. 轻型
B. 普通型
C. 迁延型
D. 逍遥型
E. 顿挫型

正确答案：D。逍遥型

解析：伤寒逍遥型全身毒血症状轻，无明显异常体征，患者可照常生活、工作。部分患者因突发肠出血或肠穿孔而就医（D对）。轻型伤寒身毒血症状轻、病程短，2周左右痊愈。多见于发病前曾接种过伤寒菌苗者，或发病早期已应用有效抗菌药物治疗者。由于缺乏典型伤寒表现，易被误诊和漏诊（A错）。伤寒迁延型 起病与典型伤寒相似、但发热呈弛张或间歇热型，可达45～60日，肝脾肿大较显著。多见于合并乙肝、胆道结石和慢性血吸虫病者（C错）。